患者为慢性淋病，小便不畅，短涩，淋沥不尽，腰酸腿软，五心烦热，疲劳易发，食少纳差，女性白带增多，舌淡边有齿痕，苔白腻，脉沉细弱。其证候是
A. 正虚毒恋
B. 湿热毒蕴
C. 毒邪流窜
D. 脾虚湿蕴
E. 热毒入络

正确答案：A。正虚毒恋

解析：根据患者腰酸腿软，五心烦热，疲劳易发为虚症，小便不畅，短涩，淋漓不尽为毒邪留恋，故其证候为正虚毒恋（A对） ；患者的热为五心烦热，另外有腰酸腿软，故为阴虚发热而不是湿热毒蕴（B错）；患者并未出现症状的转移，流窜不定（C错）；患者虽有脾虚（D错）但主证为阴虚；患者并未有热毒入络（E错）的表现，为阴虚发热。